大剂量应用异烟肼可出视神经炎，则应注意及时补充哪种药物预防不良反应
A. 维生素A
B. 维生素K
C. 维生素pp
D. 维生素B6
E. 维生素C

正确答案：D。维生素B6

解析：大剂量应用异烟肼可出视神经炎，则应注意及时补充维生素B6预防不良反应的产生。掌握“异烟肼、利福平及乙胺丁醇”知识点。